属于阿片受体拮抗剂的药物是
A. 阿法罗定
B. 四氢帕马汀
C. 丁丙诺啡
D. 二氢埃托啡
E. 纳洛酮

正确答案：E。纳洛酮